下列哪两脏的功能失调多引起“呼吸困难，动则喘甚”的临床表现
A. 肺与肝
B. 肺与心
C. 心与肾
D. 肺与肾
E. 肺与脾

正确答案：D。肺与肾

解析：肺司呼吸，肾主纳气，呼吸运动由肺所主，亦需肾纳气机能的协助。肺气肃降，吸入清气并向下运行，肾气摄纳，将吸入的清气下纳于肾，以维持呼吸的深度。“肺为气之主，肾为气之根”。病理上，肺气久虚、肃降失司与肾气不足、摄纳无权，往往互为影响，以致出现气短喘促，呼吸表浅，呼多吸少等肾不纳气的病理变化（D对）。肺与肝的关系，主要体现在人体气机升降的调节方面（A错）。肺与心的关系表现在心主血与肺主气，心主行血与肺主呼吸的关系，若肺气虚或肺失宣降可影响心主血脉，导致血液运行涩滞，出现胸闷，心悸，甚则唇青、舌紫等血淤症状（B错）。心与肾的关系主要表现在心肾相交，包括水火既济，精神互用，君相安位（C错）。肺与脾的关系主要表现在气的生成与津液代谢两个方面（E错）。